患者男性，32岁，6天前感冒后出现左下后牙区胀痛，进食、吞咽时加重。昨日起出现局部自发性跳痛，张口受限，低热，头痛，检查可见：左下颌角区颊部稍肿胀，无压痛，张口度两指，左下第三磨牙近中阻生牙龈红肿充血，挤压可见远中盲袋内少量脓液溢出，颊侧前庭沟丰满、充血，压痛明显、叩诊（-），无松动，咽侧壁稍充血，无压痛。如下颌角区存在广泛凹陷性水肿，怀疑局部脓肿形成，此时最有效检查方法为
A. 触诊
B. X线检查
C. 化验
D. 粗针头穿刺
E. 观察体温变化

正确答案：D。粗针头穿刺

解析：本题考查口腔颌面部感染的诊断。脓肿形成时，可用粗针头于病变部位行穿刺确诊（D对），若抽取出脓液，则说明有脓肿形成；对于位置深在的脓肿不易触及，难以诊断（A错）；X线检查不能反映口腔软组织病变（B错）；无脓肿形成但伴有全身症状时，化验各细胞指数有所波动（C错）；体温的变化不能直接反应脓肿是否形成（E错）。